属胞嘧啶抗代谢物的药物是
A. 甲氨蝶呤
B. 巯嘌呤
C. 吉西他滨
D. 长春瑞滨
E. 卡莫氟

正确答案：C。吉西他滨

解析：本题考查胞嘧啶抗代谢药物。吉西他滨（C对）为双氟取代的胞嘧啶核苷衍生物，属于胞嘧啶抗代谢药物。甲氨蝶呤（A错）属于叶酸类抗代谢药。巯嘌呤（B错）具有抑制肿瘤细胞增殖的作用。长春瑞滨（D错）主要作用于肿瘤细胞的DNA合成后期,使肿瘤细胞的有丝分裂増殖停止。卡莫氟（E错）是一种口服抗肿瘤的药物,属于嘧啶类。